某男，18岁。2周前出现咽痛、全身酸楚、鼻塞流涕、微恶风寒，继而咳嗽、咯痰。刻下仍时流清涕、咽中不适、咳嗽微喘、咯吐稀白痰，苔白、脉浮滑。医师处以小青龙糖浆，此成药处方的君药有
A. 麻黄
B. 干姜
C. 五味子
D. 法半夏
E. 桂枝

正确答案：A、E。麻黄；桂枝

解析：本题考查的是小青龙胶囊的方义简释。方中2周前出现咽痛、全身酸楚、鼻塞流涕、微恶风寒，继而咳嗽、咯痰。刻下仍时流清涕、咽中不适、咳嗽微喘、咯吐稀白痰，苔白、脉浮滑。医师处以小青龙糖浆，此成药处方的君药有麻黄（A对）与桂枝（E对）。小青龙胶囊：【方义简释】方中麻黄辛散温通，微苦略降，善发汗解表、宣肺止咳平喘；桂枝辛散温通，甘温助阳，善发表散寒、温阳化饮。两药相合，善解表散寒化饮、宣肺止咳平喘，共为君药。细辛芳香气浓，辛温走窜，善解表散寒、温肺化饮；干姜（B错）辛热温散，善散寒、温肺化饮。两药相合，助君药解表散寒、温化痰饮，故为臣药。肺气逆甚，纯用辛温发散之品，恐耗伤肺气，须防温燥伤津，故用五味子（C错）酸敛质润温补，以滋肾敛肺止咳；白芍甘补酸敛，苦微寒兼清泄，善养血敛阴。又投辛温之法半夏（D错），其辛散温燥，有毒而力较强，功善燥湿化痰、和胃降逆，以助君臣药化寒饮。故此三药共为佐药。炙甘草甘补和缓，平而偏温，既益气和中，又调和诸药，故为使药。全方配伍，主辛散温化，兼酸甘收敛，共奏解表化饮、止咳平喘之功，故善治风寒水饮所致的恶寒发热、无汗、喘咳痰稀。